香豆素与碱反应的特点是
A. 遇碱后内酯水解开环，加酸后又可环合成内酯环
B. 加碱内酯水解开环，生成顺式邻羟桂皮酸盐，加酸不环合，但长时间加热可生成反式邻羟桂皮酸盐
C. 加碱内酯水解开环，加酸后又可环合成内酯环，但如长时间在碱中加热，生成反式邻羟桂皮酸盐，加酸不能环合
D. 加碱内酯水解开环，并伴有颜色反应
E. 加碱生成的盐可溶于水

正确答案：C。加碱内酯水解开环，加酸后又可环合成内酯环，但如长时间在碱中加热，生成反式邻羟桂皮酸盐，加酸不能环合

解析：本题考查的是香豆素的理化性质。香豆素与碱反应的特点是加碱内酯水解开环，加酸后又可环合成内酯环，但如长时间在碱中加热，生成反式邻羟桂皮酸盐，加酸不能环合（C对）。香豆素与碱的作用及其应用：香豆素类及其苷因分子中具有内酯环，在热稀碱溶液中内酯环可以开环生成顺邻羟基桂皮酸盐，加酸又可重新闭环成为原来的内酯（AD错）。但长时间在碱中放置或UV光照射，则可转变为稳定的反邻羟基桂皮酸盐，再加酸就不能环合成内酯环（B错）。香豆素与浓碱共沸，往往得到酚类或酚酸等裂解产物。因此用碱液提取香豆素时，必须注意碱液的浓度，并应避免长时间加热，以防破坏内酯环。7位甲氧基香豆素较难开环，这是因为7-OCH₃的供电子效应使羰基碳的亲电性降低，7-羟基香豆素在碱液中由于酚羟基酸性成盐，更难水解（E错）。对于香豆素及其苷类，我们可以利用上述性质进行该类化合物的提取和精制，即先溶解于热稀苛性碱的水溶液中，酸化后沉淀析出，借以和杂质分离从而达到提取和精制的目的。如由秦皮中提取治疗菌痢的有效成分，就可用此法。